库欣综合征常见的面容
A. 苦笑面容
B. 粘液性水肿面容
C. 满月脸
D. 惊恐面容
E. 丑陋面容

正确答案：C。满月脸

解析：库欣综合征的常见面容为满月脸（C对），脸圆而呈暗红色，锁骨上窝、颈背部和腹部脂肪堆积增多，呈典型的满月脸、鲤鱼嘴、水牛背、锁骨上窝脂肪垫和悬垂腹特征，四肢相对瘦小。苦笑面容（A错）常见于破伤风病人。黏液性水肿面容（B错）常见于甲状腺功能减退的病人。惊恐面容（D错）常见于甲状腺功能亢进病人。丑陋面容（E错）见于肢端肥大病人。